应对心理应激的方法多种多样，其中不太常用的方法有
A. 调整对应激事件的认知和态度，常常需要增加期望值
B. 采用自我防御机制
C. 学会放松和自我调节
D. 增加对应激事件的可控性和可预测性
E. 提高自身应对能力与经验

正确答案：A。调整对应激事件的认知和态度，常常需要增加期望值